属于二级预防的是
A. 游说进行烟草广告立法
B. 对高血压患者的全面监管
C. 在高危人群中定期检测HIV
D. 残疾患者中假肢、矫正器、轮椅等的应用
E. 定期对成年人进行心血管疾病危险因素评估

正确答案：C。在高危人群中定期检测HIV

解析：本题考查二级预防。第二级预防又称“三早”预防，即早发现、早诊断、早治疗。疾病的早发现可通过筛检、病例发现、定期体检等实现。例如，在高危人群中定期检测HIV（C对ABDE错）。